肉眼见囊壁较薄，囊腔内含有牙冠，囊壁附着于牙颈部，囊液多呈黄色，为以上哪种疾病的表现
A. 含牙囊肿
B. 根尖周囊肿
C. 鳃裂囊肿
D. 鼻腭管囊肿
E. 萌出囊肿

正确答案：A。含牙囊肿

解析：本题考查牙源性囊肿。含牙囊肿（A对）肉眼见囊壁较薄，囊腔内含有牙冠，囊壁附着于牙颈部，囊液多呈黄色。此题未特别提出为在软组织，所以萌出囊肿（E错）不妥。